男，65岁。大量饮酒30年，因意识不清半天入院，查体：面色晦暗，扑翼样震颤阳性。该患者意识障碍可能的原因是
A. 肝性脑病
B. 电解质紊乱
C. 代谢反应
D. 慢性酒精中毒
E. 低血糖发作

正确答案：A。肝性脑病

解析：中老年男性，多年饮酒史（长期饮酒可加速肝硬化的形成，由此引发肝性脑病），患者意识不清、面色晦暗、扑翼样震颤阳性（意识障碍、扑翼样震颤阳性是肝性脑病的典型特点），综合以上的病史、体征、查体，该患者意识障碍最可能的原因是肝性脑病（A对）。大量饮酒虽然可引起电解质紊乱（B错），但多表现为血清钠、钙、钾、镁异常，一般无扑翼样震颤及面色晦暗；代谢反应（P766）（C错）多指蛋白质、脂肪、碳水化合物代谢紊乱，一般无扑翼样震颤；慢性酒精中毒（P900）（D错）会引起小脑功能障碍综合征，导致意向性肌颤，但不会出现扑翼样震颤；低血糖发作（P750）（E错）可表现为嗜睡、头晕、视物不清、幻觉、躁动、行为怪异等临床症状，可有锥体束征阳性。